女孩，8岁。发热、关节肿痛2周。查体：皮肤出现环形红斑，心率120次/分，奔马律。实验室检查提示血沉增快。经治疗，述症状、体征消失。预防复发的方法是
A. 忌海鲜
B. 减少体育运动
C. 长效青霉素肌注
D. 避免关节损伤
E. 激素吸入维持

正确答案：C。长效青霉素肌注

解析：女孩，8岁（风湿热最常见人群是5～15岁的儿童和青少年）。发热（风湿热的前驱症状）、关节肿痛2周（关节炎是风湿热最常见的典型表现，关节疼痛通常在2周内消退）。查体：皮肤出现环形红斑（属于风湿热的典型表现），心率120次/分，奔马律（风湿性心脏炎的表现）。实验室检查提示血沉增快（80％的急性期风湿热病人血沉增快）。综合该患者的病史、临床表现、实验室检查，该患者诊断考虑为风湿热。预防风湿热复发的方法是长效青霉素肌注（C对，）。